不能补充血糖的代谢过程是
A. 肌糖原分解
B. 肝糖原分解
C. 糖类食物消化吸收
D. 糖异生作用
E. 肾小管上皮细胞的重吸收作用

正确答案：A。肌糖原分解